内科医生王某，在春节探家的火车上遇到一位产妇临产，因车上无其他医务人员，王某隧协助产妇分娩。在分娩过程中，因牵拉过度，导致新生儿左上肢臂丛神经损伤。王某行为的性质为
A. 属于违规操作，构成医疗事故
B. 属于非法行医，不属医疗事故
C. 属于超范围职业，构成医疗事故
D. 属于见义勇为，不构成医疗事故
E. 虽造成不良后果，但不属医疗事故

正确答案：E。虽造成不良后果，但不属医疗事故

解析：《医疗事故处理条例》规定了6种情形不属于医疗事故：①在紧急情况下为抢救垂危患者生命而采取紧急医学措施造成不良后果的（内科医生王某在火车上且无其他医务人员的紧急情况下协助产妇分娩，导致新生儿左上肢臂丛神经损伤，虽造成不良后果，但不属于医疗事故（E对））；②在医疗活动中由于患者病情异常或者患者体质特殊而发生医疗意外的；③在现有医学科学技术条件下，发生无法预料或者不能防范的不良后果的；④无过错输血感染造成不良后果的；⑤因患方原因延误诊疗导致不良后果的；⑥因不可抗力造成不良后果的。